下列各项中，不属于阳陵泉主治病证的是
A. 黄疸胁痛口苦
B. 腹泻水肿小便不利
C. 呕吐吞酸
D. 膝肿痛下肢痿痹
E. 小儿惊风

正确答案：B。腹泻水肿小便不利

解析：阳陵泉属于足少阳胆经腧穴，位于小腿外侧，腓骨头前下方凹陷中。主治黄疸、胁痛、口苦、呕吐、吞酸等肝胆犯胃病证第十版针灸学（AC对）；膝肿痛、下肢痿痹及麻木等下肢、膝关节疾患（D对）；小儿惊风（E对）；肩痛（B错，为本题正确答案）。